有的污染物在水环境中浓度极低且极为稳定，该污染物通过水生生物摄取进入食物链系统，使生物体内污染物浓度大大增加，这种现象被称为
A. 生物放大作用
B. 生物转化作用
C. 生物降解作用
D. 生物富集作用
E. 生物对污染物的自净作用

正确答案：D。生物富集作用

解析：本题考查生物富集作用。有的污染物在水环境中浓度极低且极为稳定，该污染物通过水生生物摄取进入食物链系统，使生物体内污染物浓度大大增加，这种现象被称为生物富集作用（D对ABCE错）。